下列关于甘露醇的叙述不正确的是
A. 脱水需静脉给药
B. 体内不被代谢
C. 不易通过毛细血管
D. 提高血浆渗透压
E. 易被肾小管重吸收

正确答案：E。易被肾小管重吸收